可摘局部义齿中有传导力作用的部件中，除外
A. 人工牙
B. 基托
C. 大、小连接体
D. 卡环体
E. 卡臂尖

正确答案：E。卡臂尖

解析：卡环臂尖位于倒凹区，是卡环产生固位作用的部分，可防止义齿（牙合）向脱位，不能传导力。掌握“局部义齿人工牙及基托”知识点。